皮肤被硫酸、盐酸、硝酸灼伤应
A. 立即用5%碳酸氢钠溶液冲洗后，再用清水冲洗
B. 以大量清水或肥皂水冲洗，继以30～50%乙醇擦洗，再以饱和硫酸钠溶液湿敷，24小时内忌用油膏
C. 以5%氯化钙溶液清洗
D. 用棉花蘸松节油清除后，再涂羊毛脂
E. 以1∶2000高锰酸钾溶液洗胃

正确答案：A。立即用5%碳酸氢钠溶液冲洗后，再用清水冲洗